女，40岁，G3P1，孕42周，规律宫缩7小时，宫口开7CM，S+3，LOA，预估胎儿体重3500g，胎心率正常，体温36.7摄氏度，血压140/90mmHg，心率正常，WBC15.6x10⁹/L，支持产妇绒毛羊膜炎诊断的依据是
A. 血压140/90mmhg
B. 体温36.7摄氏度
C. 胎心率正常
D. 宫口开7CM
E. WBC15.6*10ˆ9

正确答案：E。WBC15.6*10ˆ9

解析：绒毛膜羊膜炎的诊断靠临床表现：母体体温≥38°C ;（B错）阴道分泌物异味；胎心率增快（胎心率基≥160 次／分）（C错） 或母体心率增快（心率≥100 次／分）；实验室检查：母体外周白细胞计数≥15x10⁹/L（E对）;血压与宫口大小（AD错）与诊断关系不大。